长期服用最易造成胃肠道损害，溃疡出血不良反应的药物是
A. β内酰胺类抗生素
B. 氨基糖苷类抗生素
C. 喹诺酮类抗菌药
D. 糖皮质激素类药物
E. 非甾体抗炎药

正确答案：E。非甾体抗炎药

解析：本题考查药物的不良反应。非甾体抗炎药（E对）长期使用可引起消化道疾病，造成胃肠道损伤、胃出血、胃溃疡、胃穿孔等不良反应。β-内酰胺类抗生素（A错）的不良反应为过敏反应。氨基糖苷类抗生素（B错）主要不良反应为耳毒性和肾毒性。喹诺酮类抗菌药（C错）的不良反应有影响软骨发育、胃肠道反应、中枢反应和诱发癫痫等。糖皮质激素类药物（D错）的不良反应有皮质功能亢进综合征、诱发或加重感染、诱发或加重溃疡病、骨质疏松等。